Km值是指反应速度为1/2Vmax时的
A. 酶浓度
B. 底物浓度
C. 抑制剂浓度
D. 激活剂浓度
E. 产物浓度

正确答案：B。底物浓度

解析：Km为米氏常数，其值是指反应速度为1/2Vmax时的底物浓度（B对）。